长臂卡环不应进入
A. 近缺隙基牙的倒凹区
B. 近缺隙松动基牙的倒凹区
C. 松动基牙颊侧的倒凹区
D. 松动基牙舌侧的倒凹区
E. 近缺隙基牙的相邻牙的倒凹区

正确答案：B。近缺隙松动基牙的倒凹区

解析：长臂卡环：又称延伸卡环。该卡环任何部件不应进入近缺隙松动基牙的倒凹区。掌握“局部义齿固位体”知识点。